男，重体力劳动工人。腰腿痛，向左下肢放射，咳嗽、喷嚏时加重1月。检查：腰部活动明显受限，并向左倾斜，直腿抬高试验阳性。病程中无低热盗汗消痩症状。为明确诊断最有意义的检查是
A. X线检查
B. CT
C. 超声
D. 腰椎穿刺
E. 肌电图

正确答案：B。CT

解析：患者男性、重体力劳动工人，腰腿痛、向左下肢放射、咳嗽喷嚏时加重（腰椎间盘突出症典型表现），腰部活动明显受限、向左倾斜，直腿抬高试验阳性（腰椎间盘突出症的重要体征），结合患者症状和体征，该患者首先考虑的诊断是腰椎间盘突出症，为明确诊断，最有意义的检查是MRI，其次为CT，所给选项中无MRI，故本题最有意义的检查是CT（B对）。X线检查（P733）（A错）不能直接反映是否存在椎间盘突出，仅可根据脊柱所发生的变化间接判断，通常只作为常规检查，对本病诊断意义不大。B超（C错）多用于脊柱手术中的检测探查，对诊断意义不大。腰椎穿刺（D错）多用于中枢神经系统感染、肿瘤等疾病的诊断。肌电图（P733）（E错）可以协助腰椎间盘突出的诊断，但其诊断价值不及MRI和CT。